患儿，女，4岁半，身高110cm，体重15kg。一天前开始发热（39.1℃），咽稍痛，无咳嗽，无吐泻，家长在家选用退烧药对症治疗。发病20h左右出现腹泻，约2～3h一次大便，量少，黄色黏液便，呕吐1次。体格检查：T38.8℃，P118次/分，R28次/分，咽微充血，出现轻微脱水症状。双肺呼吸音清，腹平，肝脾未触及，肠鸣音活跃，实验室检查：WBC18.5×10⁹/L（参考值4.0×10⁹～10.0×10⁹/L），粪便镜检可见红、白细胞。该患者的临床表现及实验室检查结果常见于
A. 动力性腹泻
B. 消化不良性腹泻
C. 感染性腹泻
D. 分泌性腹泻
E. 出血坏死性腹泻

正确答案：C。感染性腹泻

解析：本题考查腹泻的临床诊断。患者粪便为黄色黏液便，黏液便常见于感染性腹泻，且患者白细胞值超过了正常值，白细胞增加常见于急性感染，即判断患者为感染性腹泻（C对）。